女性，55岁。丧偶8年，现独居，嗜烟酒，不爱运动。平时性情抑郁，过分容忍，办事无主见，常顺从于别人。1月前行胃癌切除，术中及术后情绪低落，兴趣下降，常独自流泪，有轻生之念。病人患胃癌的主要原因为
A. 生活事件
B. 易感性人格特征
C. 情绪因素
D. 不良生活习惯
E. 以上都是

正确答案：E。以上都是